反映机体肺通气能力的指标是
A. 肺活量指数
B. 握力指数
C. BMI指数
D. 身高坐高指数
E. 身高体重指数

正确答案：A。肺活量指数